男，28岁。乏力、纳差10余天。伴厌油及干呕、小便浓茶色。查体：皮肤、巩膜黄染、剑突下轻压痛，无反跳痛，肝脾肋下未触及。实验:AST1585U/L，ALT1847U/L，TBil85.20µmol/L。乙肝表面抗原、乙肝E抗原、乙肝核心抗体均阳性。该患者肝脏最可能的病变是
A. 肝细胞淤胆和羽毛状坏死
B. 肝细胞桥接坏死和碎片状坏死
C. 肝细胞广泛变性和点灶状坏死
D. 肝细胞大片坏死并结节状再生
E. 仅汇管区淋巴细胞浸润

正确答案：C。肝细胞广泛变性和点灶状坏死

解析：根据患者的症状、体征及实验室检查可以诊断为急性乙型肝炎，其病变是肝细胞广泛变性和点灶状坏死（C对）。肝细胞淤胆和羽毛状坏死（A错）为胆汁性肝硬化的病理特点。肝细胞桥接坏死和碎片状坏死（B错）为慢性乙型肝炎的病理特点（P220）。肝细胞大片坏死并结节状再生（D错）为亚急性重型肝炎的病理特点。仅汇管区淋巴细胞浸润（E错）为慢性肝炎G1级病理特点（P220表11-4）。